患者肢体痿软，身体困重，足胫热气上腾，发热，胸痞脘闷，舌苔黄腻，脉滑数。其治法是
A. 清热润燥，养肺生津
B. 清热利湿，通利筋脉
C. 泻南补北，滋阴清热
D. 补益肝肾，清热滋阴
E. 补益脾气，健运升清

正确答案：B。清热利湿，通利筋脉

解析：本病例以肢体痿软为主，故诊断为痿证；湿热浸淫经脉，气血阻滞，故肢体痿软；湿热浸渍肌肤，故身体困重；湿热郁蒸，气机不化，故足胫热气上腾，发热；胸痞脘闷，乃湿阻气机之故；舌苔黄腻，脉滑数，为湿热内盛之征，故其证候为湿热浸淫证，治以清热利湿，通利筋脉，代表方为加味二妙散（B对）。清热润燥，养肺生津，是痿证之肺热津伤证的治法(A错)。泻南补北，滋阴清热不是痿证的治法（C错）。补益肝肾，清热滋阴，是痿证之肝肾亏虚证的治法（D错）。补益脾气，健运升清，是痿证之脾胃虚弱证的治法（E错）。